患者，女，43岁。左下后牙肿痛3天就诊。检查见左下第一磨牙远中颈部龋，龋深及牙髓。无探痛，Ⅲ度松动，叩痛（+++），颊侧根尖部龈红肿，扪痛，有波动感，左面下部轻度肿胀，体温38℃。当日就诊处理
A. 开髓开放、消炎镇痛
B. 开髓暂封、切开引流
C. 切开引流、消炎镇痛
D. 开髓暂封、切开引流、消炎镇痛
E. 拔牙、消炎镇痛

正确答案：D。开髓暂封、切开引流、消炎镇痛

解析：本题考查急性根尖周炎。当日就诊处理开髓暂封、切开引流、消炎镇痛（D对）。波动感是切开引流的指征，化脓性根尖周炎的首要治疗目的就是缓解疼痛，最有效的措施就是建立有效引流路径，缓解局部压力，仅仅通过髓腔引流不足以达到引流目的，切开排脓是最有效的方法。题目提示有发热症状，表明需要做抗感染处理，开髓暂封、切开引流、消炎镇痛为最佳处理方案。开髓开放、消炎镇痛（A错），开髓暂封、切开引流（B错），切开引流、消炎镇痛（C错），拔牙、消炎镇痛（E错）均不符合题干要求。